男，70岁。突发剧烈头痛、呕吐、左侧肢体活动障碍6小时，昏迷5小时。1小时前呕暗红色血液1次。应首先考虑的呕血原因是
A. 急性胃黏膜病变
B. Dieulafoy病变
C. 胃癌
D. 肝硬化食管胃底静脉曲张破裂
E. 十二指肠溃疡

正确答案：A。急性胃黏膜病变

解析：患者突发剧烈头痛、呕吐、左侧肢体活动障碍6小时（颅内高压症状），患者处于处于应激状态，交感神经兴奋，胃黏膜血管痉挛性收缩导致胃黏膜缺血缺氧，急性胃黏膜病（A对）变引起胃内出血、呕血。Dieulafoy 病变（B错）主要症状是反复发作性呕血和柏油样大便，严重者可出现失血性休克；出血前无明显上腹部不适和疼痛。胃癌（P347）（C错）常见消化道症状，如上腹不是、餐后加重、厌食、纳差、乏力、体重减轻、转移并发症等。肝硬化食管胃底静脉曲张破裂（P425）（D错）呕吐鲜红色血液，且为急性大出血。十二指肠溃疡（P339）（E错）多见于青壮年，当出血量大时可出现昏厥和休克症状。